男性，20岁，在春季皮肤出现紫色斑点，检查可见皮肤出现紫癜，且发病前全身不适，低热，乏力，轻度感冒等症状。且全身的关节肿胀、压痛，关节灵活性受限。平时体健无不适，综合以上情况，考虑诊断为
A. 特发性血小板减少性紫癜
B. 过敏性紫癜（关节型）
C. 过敏性紫癜（混合型）
D. 过敏性紫癜（Henoch型）
E. DIC

正确答案：B。过敏性紫癜（关节型）

解析：过敏性紫癜多见于青少年，好发于春秋季节，男性略多于女性，而关节型过敏型紫癜除了皮肤紫癜外，尚有关节肿胀、疼痛、压痛及功能障碍等表现，多发生于膝、肘、踝、腕等大关节，游走性反复发作，数日愈合，不遗留关节畸形。掌握“过敏性紫癜”知识点。